呃逆病变的关键脏腑是
A. 肝
B. 脾
C. 肺
D. 胃
E. 胆

正确答案：D。胃

解析：呃逆多由饮食不当，情志不遂，或病后体虚导致胃失和降，胃气上逆动膈而致。在生理上胃居于膈之下，肺居于膈之上，肺胃直接相互联系，肺失肃降可致胃失和降，胃气上逆，致膈间气机不畅，逆气动膈，而成呃逆。此外，肺胃之气的和降，依赖于肾气的摄纳，若久病及肾，肾失摄纳，则肺胃之气不能顺降，可上逆动膈而成呃逆。胃之和降还依赖于肝之条达，若肝气郁滞，失于条达，横逆犯胃，气逆动膈，而成呃逆。无论是何种因素，终影响胃的和降，致胃气上逆动膈，故胃为呃逆病变的关键脏腑（D对ABCE错）。